患者牙痛甚烈，兼有口臭，口渴，便秘，脉洪等症。治疗应首选
A. 风池
B. 外关
C. 内庭
D. 行间
E. 太溪

正确答案：C。内庭

解析：患者牙痛甚烈，兼有口臭、口渴、便秘、脉洪等，为阳明火盛之胃火牙痛。治法为泻火通络止痛，主穴选颊车、下关、合谷，在主穴基础上，选用内庭（C对）、二间清泻胃火；如果辨证属风火牙痛者选风池（A错）、外关（B错）；虚火牙痛者选太溪（E错）、行间（D错）。